结构中含两个手性中心的阿片μ受体弱激动剂药物是
A. 吗啡
B. 盐酸哌替啶
C. 盐酸曲马多
D. 盐酸美沙酮
E. 酒石酸布托啡诺

正确答案：C。盐酸曲马多

解析：本题考查镇痛药物的结构特点。盐酸曲马多（C对）是微弱的μ阿片受体激动药，分子中有两个手性中心，临床用其外消旋体。